一氧化碳中毒，可见
A. 皮肤黏膜呈樱桃红色
B. 皮肤干燥
C. 皮下气肿
D. 皮肤瘀斑
E. 皮肤潮湿

正确答案：A。皮肤黏膜呈樱桃红色

解析：一氧化碳中毒的特征性病变是皮肤黏膜呈樱桃红色（A对）。皮肤干燥（B错）为缺水的表现，皮下气肿（C错）为气滞的表现，皮肤瘀斑（D错）提示有血瘀，皮肤潮湿（E错）提示体内湿气比较重。